涡轮机喷水的主要目的是为了
A. 增加转速
B. 便于钻磨
C. 冲洗洁净
D. 降低温度

正确答案：D。降低温度

解析：本题考查涡轮机喷水的目的。在窝洞预备过程中涡轮机反复切割牙体组织产热，涡轮机喷水可降低牙齿表面温度，减少对牙髓的刺激，保护牙髓（D对），这是涡轮机喷水的主要目的；同时能将切割掉的龋坏组织冲洗干净（C错），保持窝洞内清洁，使视野清晰，便于钻磨（B错）。涡轮机的转速不会因喷水而增加（A错）。